下列疾病中主要发生在口腔黏膜上的是
A. 复发性阿弗他溃疡
B. 扁平苔藓
C. 多形性红斑
D. 白塞病
E. 红斑狼疮

正确答案：A。复发性阿弗他溃疡

解析：本题考查口腔黏膜溃疡类疾病。复发性阿弗他溃疡（A对）又称复发性口腔溃疡，是最常见的口腔黏膜溃疡类疾病，主要发生在口腔黏膜上。扁平苔藓（B错）是一种有慢性浅表性炎症的皮肤-粘膜角化异常性疾病，皮肤和黏膜同时受累。多形性红斑（C错）又称多形渗出性红斑，是黏膜-皮肤的一种急性渗出性炎症性疾病，皮肤和黏膜。白塞病（D错）是一种以细小血管炎为病理基础的慢性进行性、复发性、系统性损害性疾病，与患者自身免疫力降低有关。主要特点是口腔、生殖器、皮肤溃疡，其中口腔溃疡是主要临床症状。红斑狼疮（E错）是一种慢性皮肤-黏膜结缔组织疾病，皮肤和黏膜同时受累。